对花粉过敏的前列腺增生患者，不宜选用的药物是
A. 多沙唑嗪
B. 托特罗定
C. 非那雄胺
D. 坦索罗辛
E. 舍尼通(普适泰）

正确答案：E。舍尼通(普适泰）

解析：本题考查舍尼通(普适泰）。对花粉过敏的前列腺增生患者，不宜选用的药物是舍尼通(普适泰）（E错，为本题正确答案）。舍尼通(普适泰）的主要成份为水溶性花粉提取物P5，脂溶性花粉提取物EAlO，对花粉过敏的前列腺增生患者不宜选用。多沙唑嗪（A对）不良反应为腹痛、消化不良、恶心、乏力、周围性水肿等，对花粉过敏的前列腺增生患者可选用。托特罗定（B对）不良反应为口干、尿潴留，严重胃肠动力障碍、重症肌无力、闭角型青光眼、正在使用酮康唑等强力CYP3A4抑制剂的重度肝、肾功能不全患者禁用，便秘者慎用，对花粉过敏的前列腺增生患者可选用。非那雄胺（C对）不良反应为性功能影响、乳房不适和皮疹，对花粉过敏的前列腺增生患者可选用。坦索罗辛（D对）不良反应为失神、意识丧失，对花粉过敏的前列腺增生患者可选用。